主要用于革兰阴性菌感染，而对革兰阳性菌作用差的药物是
A. 阿莫西林
B. 亚胺培南
C. 氨曲南
D. 克拉维酸
E. 替莫西林

正确答案：E。替莫西林

解析：本题考查替莫西林。替莫西林（E对）为耐β-内酰胺酶的半合成青霉素类抗生素，对G⁻杆菌作用强，但对铜绿假单胞菌无效，对G⁺作用弱。阿莫西林（A错）为广谱青霉素类，主要作用于对青霉素敏感的革兰阳性菌以及部分革兰阴性杆菌。亚胺培南（B错）为碳青霉烯类，对革兰阳性菌、革兰阴性菌、需氧菌、厌氧菌均有很强的抗菌活性。氨曲南（C错）对需氧革兰阴性菌作用强。克拉维酸（D错）为β-内酰胺酶抑制剂，本身只有较弱的抗菌活性，可与β-内酰胺类抗生素联合应用，增强药效。